女，17岁。反复发作咳嗽、咳痰10年。近3年反复咯血，最多一次量约200ml。现胸部CT示左下叶肺萎缩，可见囊柱状支气管扩张影像。最佳治疗方案是
A. 吸氧、止血治疗
B. 抗炎治疗
C. 解痉、化痰
D. 左肺下叶切除
E. 体位排痰

正确答案：D。左肺下叶切除

解析：患者青少年女性（支气管扩张好发人群），反复发作咳嗽、咳痰10年。近3年反复咯血（支气管扩张常见症状），胸部CT示左下叶肺萎缩，可见囊柱状支气管扩张影像（支气管扩张常见影像学表现）。以上病例提示该患者明确诊断为局限性支气管扩张，且患者无手术禁忌证表现，故最佳治疗方案应为手术治疗（D对）。吸氧、止血治疗（A错）、抗炎治疗（B错）、解痉、化痰（C错）、体位排痰（E错）均属于内科保守治疗，仅作为辅助治疗手段而非最佳治疗方案。